小儿药物剂量计算常用方法不包括
A. 按身高计算
B. 按体重计算
C. 按体表面积计算
D. 按年龄计算
E. 按成人量折算

正确答案：A。按身高计算

解析：小儿用药剂量较成人更须准确，计算方法有多种：按体重、体表面积、年龄或按成人剂量折算，按身高计算不属于小儿药物剂量计算常用方法（A错，为本题正确答案）。按体重计算（B对）是西医最常用、最基本的计算方法，应以实际测得体重为准，或按公式计算获得，每日（次）剂量=病儿体重（kg）×每日（次）每千克体重需要量。按体表面积计算（C对）此法较按年龄、体重计算更为准确，小儿体表面积计算公式为：<30kg小儿体表面积（㎡）=0.035×体重（kg）+0.1；>30kg小儿体表面积（㎡）=0.02×[体重（kg）-30]+1.05。小儿剂量=剂量/（㎡）×小儿体表面积（㎡）。按年龄计算（D对）适用剂量幅度大，不需十分精确的药物，如营养类药物可按年龄计算，比较简单易行。按成人量折算（E对）：小儿剂量=成人剂量×小儿体重（kg）/50，此法仅用于未提供小儿剂量的药物，所得剂量一般偏小，故不常用。